相对误差表示
A. 测量值与真实值之差
B. 误差在测量值中所占的比例
C. 最大的测量值与最小的测量值之差
D. 测量值与平均值之差
E. 测量值与平均值之差的平方和

正确答案：B。误差在测量值中所占的比例